下列哪一种测量常用来作为计算某病发病率的分母
A. 观察到的病例数
B. 观察到的新病例数
C. 无症状病例数
D. 观察人年数
E. 失访人数

正确答案：D。观察人年数